治疗胃热呕逆，宜选用
A. 石膏
B. 知母
C. 芦根
D. 天花粉
E. 夏枯草

正确答案：C。芦根

解析：该题考查芦根的应用。石膏生用能清热泻火，除烦止渴，煅用能敛疮生肌，收湿止血（A错）。知母具有清热泻火，滋阴润燥的功效（B错）。芦根具有清热泻火，生津止渴，除烦，止呕，利尿的功效，能清胃热而止呕逆（C对）。天花粉具有清热泻火，生津止渴，消肿排脓（D错）。夏枯草具有清热泻火，明目，散结消肿的功效（E错）。